下列化学物质中毒性最大的是
A. CHCl₃
B. CH₂Cl₂
C. CH₃Cl
D. CCl₄
E. CH₄

正确答案：D。CCl₄